男性，74岁，咳嗽，偶痰中带血，胸痛近2个月，后前位片示左肺门肿块影约3cm大小，边缘有分叶征，伴有左上叶肺不张。应考虑为
A. 肺结核
B. 肺炎
C. 肺结节
D. 肺癌
E. 肺脓肿

正确答案：D。肺癌

解析：肺癌时可有咳嗽，偶痰中带血，胸痛的症状，影像学检查示左肺门肿块影约3cm大小，边缘有分叶征，伴有左上叶肺不张，为肺癌征象（D对）。原发型肺结核的典型表现有3个X线征：①原发浸润②淋巴管炎。③肺门、纵隔淋巴结肿大（A错）。支气管肺炎的X线表现：早期表现为肺纹理增粗，增多，然后随着病情的进展，可能会出现斑点状或斑片状阴影。严重者，斑点状、斑片状会逐渐增大，成为斑片状阴影，融合成大片，甚至整个肺段都会波及（B错）。肺结节X线胸片：双侧肺门及纵隔淋巴结对称性肿大（偶见单侧肺门淋巴结肿大），伴或不伴有肺内网状、结节状、片状阴影。必要时参考胸部CT进行分期（C错）。肺脓肿见到大团片状致密阴影，肺实质内有空腔形成，空洞内壁有的完整，有的不规则，可以见到液体平面呈后壁空洞；贴近胸壁的那侧与胸壁呈锐角，周边组织与空洞界限不是很清楚（E错）。